支原体不同于L型细菌的是
A. 缺乏细胞壁
B. 具有DNA和RNA两种核酸
C. 可通过细菌滤器
D. 培养时形成油煎蛋样菌落
E. 形态结构不因有无青霉素等诱因而改变

正确答案：E。形态结构不因有无青霉素等诱因而改变